骨与关节结核发病率最高的部位
A. 肩关节
B. 肘关节
C. 脊柱
D. 髋关节
E. 膝关节

正确答案：C。脊柱

解析：骨与关节结核是最常见的肺外继发性结核，好发于负重大、活动多、易损伤的部位，各部位发病率由高到低依次为脊柱（C对）、膝关节（E错）、髋关节（D错），肩关节（A错）和肘关节（B错）等部位较少见。